下列不属于预防口腔医学初级预防的是
A. 口腔健康教育
B. 口腔卫生指导
C. 控制牙菌斑
D. 固定修复
E. 消除致病因素

正确答案：D。固定修复

解析：本题考查分级预防的原则。下列不属于预防口腔医学初级预防的是固定修复（D错，为本题的正确答案）。分级预防：1.一级预防是针对病因的预防措施，是疾病发生前的预防。消除致病因素（E对），防止对人体的危害是一级预防的主要任务。如自我口腔保健（B对）、口腔健康教育（A对）、氟化物和窝沟封闭剂的使用、刷牙漱口、控制菌斑（C对）等。2.二级预防是针对疾病早期的预防措施，即在疾病发生的前期做到早期诊断和早期治疗。如早期龋病充填、牙龈炎治疗等。3.三级预防是针对疾病处于中后期时的预防措施，通过有效的治疗措施，防止病情恶化，预防并发症和后遗症，尽量恢复或保留口腔功能，如牙列缺损和缺失的修复等。